低镁血症对心肌生理特性的影响是
A. 兴奋性下降，传导性下降，自律性下降，收缩性下降
B. 兴奋性下降，传导性下降，自律性升高，收缩性升高
C. 兴奋性升高，传导性下降，自律性升高，收缩性升高
D. 兴奋性升高，传导性升高，自律性升高，收缩性升高
E. 兴奋性下降，传导性升高，自律性下降，收缩性下降

正确答案：C。兴奋性升高，传导性下降，自律性升高，收缩性升高

解析：低镁血症使心肌细胞静息电位负值减小，心肌细胞兴奋性升高（ABE错）。低镁血症时心肌快反应自律细胞钠离子内流加速，心肌自律性升高。低镁血症使Na⁺-K⁺-ATP酶活性降低，导致肾保钾功能减退而致低钾血症。低钾血症也可引起心肌兴奋性升高，传导性降低（D错），自律性升高，收缩性升高（C对）。